女，48岁。近1个月来出现口渴。每日饮水量约2000ml。身高156cm，体重70kg。患者空腹血糖180mg/dL(10.0mmol/L），餐后血糖252mg/dL(14.0mmol/L），过去无糖尿病病史。该患者的治疗措施是
A. 饮食+运动
B. 磺脲类降血糖药
C. α-葡萄糖苷酶抑制剂
D. 双胍类降血糖药
E. 使用胰岛素

正确答案：A。饮食+运动

解析：患者女，48岁。近1个月来出现口渴。身高156cm，体重70kg。患者空腹血糖180mg/dL(10.0mmo1/L），餐后血糖252mg/dL(14.0mmo1/L），过去无糖尿病病史。诊断为2型糖尿病，肥胖，由于初次诊断，首先采用饮食+运动疗法（A对），有助于减轻体重及改善高血糖、脂代谢紊乱等情况，后期可根据血糖情况考虑是否加用降糖药物。磺脲类降血糖药用于饮食+运动不能使血糖达标的2型糖尿病（B错）。α-葡萄糖苷酶抑制剂（C错）主要用于2型糖尿病，单独应用可降低餐后血糖与空腹血糖和血浆胰岛素水平，与其他口服降糖药联合应用可提高疗效。双胍类降血糖药和胰岛素一般不用于首次确诊的2型糖尿病（DE错）。